队列研究
A. 人为控制研究条件
B. 设立对照组
C. 两者均有
D. 两者均无

正确答案：B。设立对照组

解析：本题考查队列研究的特点。队列研究的基本特点为：1.属于观察法，队列研究中的暴露不是人为给予的，而是在研究之前已经客观存在的，不受研究者意志决定的（A错）；2.设立对照组（B对CD错）；3.由因及果；4.检验暴露与结局的因果关系能力较强。